在单因素方差分析中，以下正确的一项是
A. 若处理因素无作用，理论上F值接近0
B. 若处理因素无作用，理论上F值很大
C. 若处理因素有作用，理论上F值接近1
D. 若处理因素有作用，理论上F值接近0
E. 若处理因素无作用，理论上F值接近1

正确答案：E。若处理因素无作用，理论上F值接近1